含有马兜铃酸的中药，可引起的典型药源性疾病是
A. 粒细胞减少症
B. 消化性溃疡
C. 慢性肾衰竭
D. 溶血性贫血
E. 呼吸抑制

正确答案：C。慢性肾衰竭

解析：本题考查药源性疾病。含有马兜铃酸的中药引起肾损害的主要特点是肾间质纤维化，从而可引起急、慢性肾小管间质性病变，可表现为急、慢性肾衰竭（C对）。服用氯霉素、磺胺类药物、吲哚美辛等可引起粒细胞减少（A错）。布洛芬、吲哚美辛、阿司匹林等可引起消化性溃疡（B错）。苯妥英钠、氯丙嗪、利福平等可引起溶血性贫血（D错）。快速静脉注射克林霉素可引起呼吸抑制（E错）。